男，32岁。因十二指肠溃疡行毕II式胃大部切除术后6个月。术后出现反酸、烧心症状。应用抑酸剂治疗无效。上述症状逐渐加重，并呕吐胆汁样物，上腹部及胸骨后灼烧样疼痛，体重减轻。查体：T36.5℃，P80次/分，BP120/80mmHg，贫血貌，消瘦，营养不良，巩膜无黄染，心肺查体未见异常。胃镜检查见黏膜充血、水肿、糜烂，胃液中无游离酸，最适当的治疗措施是
A. 采取少食多餐方式
B. 行Roux-en-Y胃空肠吻合术
C. 长期应用消胆胺治疗
D. 应用受体拮抗剂
E. 注意餐后平卧

正确答案：B。行Roux-en-Y胃空肠吻合术

解析：青年男性患者，因十二指肠溃疡行毕II式胃大部切除术，术后6个月出现反酸、烧心症状，呕吐胆汁样物。应用抑酸剂治疗无效，胃液中无游离酸，上腹部及胸骨后灼烧样疼痛，体重减轻。胃镜检查见黏膜充血、水肿、糜烂（提示碱性反流性胃炎），结合患者病史、体查和相关检查，应诊断为碱性反流性胃炎。该患者症状较重，最适当的治疗措施是行Roux-en-Y胃空肠吻合术（B对）。采取少食多餐方式（A错）、长期应用消胆胺治疗（C错）、应用受体拮抗剂（D错）、注意餐后平卧（E错）等内科保守治疗适用于症状较轻的患者。